易发生股疝的部位
A. 腹股沟内侧窝
B. 腹股沟外侧窝
C. 直肠膀胱陷凹
D. 直肠子宫陷凹
E. 股凹

正确答案：E。股凹

解析：易发生股疝的部位为股凹(E对)。